患者，女，27岁。停经40天，查尿妊娠试验阳性。阴道出血2天，量少，色淡黯，伴腰膝痠软，头晕耳鸣，夜尿频多，舌淡苔白，脉沉滑尺弱。其证候是
A. 热
B. 气虚
C. 肾虚
D. 血虚
E. 阴虚

正确答案：C。肾虚

解析：患者妊娠40天，阴道出血，属先兆流产，量少，色淡黯，腰膝酸软，头晕耳鸣夜尿频多，舌淡苔白，脉沉滑尺弱均为肾虚之征（C对）。血热证以身热口渴，斑疹吐衄，烦躁谵语，舌绛，脉数等为主要表现的实热证候（A错）。气虚证以神疲乏力，气短，气陷，脏器下垂，自汗，或大便、小便、经血、精液、胎元等不固，脉微为主要表现（B错）。血虚证以面、睑、唇、舌色淡白，心悸，脉微为主要表现（D错）。阴虚证以咽干、五心烦热、盗汗、脉细数为主要表现的虚热证候（E错）。